关于女性生殖器淋巴引流，错误的是
A. 宫颈淋巴大部分汇入髂外淋巴结及骶前淋巴结
B. 阴道下段的淋巴引流主要汇入腹股沟淋巴结
C. 阴道上段淋巴大部分汇入闭孔淋巴结及髂内淋巴结
D. 内生殖器淋巴分髂淋巴、腰淋巴和骶前淋巴结
E. 宫体两侧淋巴可沿圆韧带入腹股沟浅淋巴结

正确答案：A。宫颈淋巴大部分汇入髂外淋巴结及骶前淋巴结

解析：女性生殖器官和盆腔具有丰富的淋巴系统，外生殖器淋巴包括腹股沟深、浅淋巴结两部分，内生殖器淋巴（盆腔淋巴）分髂淋巴、腰淋巴和骶前淋巴结（D对）。阴道下段淋巴主要汇入腹股沟浅淋巴结（B对）。阴道上段淋巴回流基本与子宫颈淋巴回流相同，大部分汇入闭孔淋巴结及髂内淋巴结（A错，为本题正确答案）（C对），小部分汇入髂外淋巴结，经髂总淋巴结汇入腰淋巴结和（或）骶前淋巴结。子宫底、输卵管、卵巢淋巴大部分汇入腰淋巴结，小部分汇入髂内外淋巴结。子宫体前后壁淋巴可分别回流至膀胱淋巴结和直肠淋巴结。子宫体两侧淋巴结沿圆韧带汇入腹股沟浅淋巴结（E对）。